左旋多巴体内过程特点为
A. 外周用药大部分可进入中枢
B. 口服后胃排空时间与胃内pH有关
C. 口服后小肠吸收缓慢
D. 外周多巴脱羧酶抑制剂不减少其用量
E. 血药浓度个体差异较小

正确答案：B。口服后胃排空时间与胃内pH有关